属于氨基酮类镇痛药的是
A. 盐酸美沙酮
B. 枸橼酸芬太尼
C. 盐酸纳洛酮
D. 酒石酸布托啡诺
E. 苯噻啶

正确答案：A。盐酸美沙酮

解析：本题考查氨基酮类镇痛药。属于氨基酮类镇痛药的是盐酸美沙酮（A对）。美沙酮为阿片受体非环状配体，是一个高度柔性分子，由于羰基极化，碳原子上带有部分正电荷，与氨基氮原子上孤对电子相互吸引，通过非共价键的相互作用可使之与哌替啶构象相似，可以看作是开环的哌啶类化合物。在4-苯基哌啶类结构中，哌啶环的4位引入苯氨基，并在苯基氨基的氮原子上丙酰化得到4-苯氨基哌啶类结构的强效镇痛药，代表药物是枸橼酸芬太尼（B错）。盐酸纳洛酮（C错）是将羟吗啡酮结构中的17位N-甲基换成烯丙基得到的,属于半合成镇痛药。酒石酸布托啡诺（D错）属于吗啡喃类镇痛药。苯噻啶（E错）属于抗组胺类镇痛药，并有很强的抗组胺和较弱的抗乙酰胆碱作用。